下述哪个结构不属于眼副器
A. 眼睑
B. 结膜囊
C. 眶脂体
D. 眼球外肌
E. 睫状体

正确答案：E。睫状体

解析：眼副器包括眼睑（A对）、结膜囊（B对）、眶脂体（C对）和眼球外肌（D对），睫状肌（E错，为本题正确答案）不属于眼副器。